注射白喉类毒素是
A. 自然自动免疫
B. 自然被动免疫
C. 人工自动免疫
D. 人工被动免疫
E. 被动自动免疫

正确答案：C。人工自动免疫

解析：本题考查人工自动免疫。人工自动免疫指采用人工免疫的方法将疫（菌）苗和类毒素等抗原接种到人体，使机体自身的免疫系统产生对相关传染病的特异性免疫力。注射白喉类毒素是人工自动免疫（C对ABDE错）。